下列关于卵巢形态学特征，叙述正确的是
A. 皮质内不含卵泡
B. 卵巢表面无腹膜
C. 卵巢白膜是一层平滑肌组织
D. 髓质内含数以万计的始基卵泡
E. 成年妇女卵巢重约10g

正确答案：B。卵巢表面无腹膜

解析：卵巢表面无腹膜（B对），由单层立方上皮覆盖，称生发上皮，其内有一层纤维组织（C错），称卵巢白膜。再向内为卵巢实质，可分为皮质和髓质两部分。外层为皮质，是卵巢的主体，由各级发育卵泡（A错）、黄体和它们退化形成的残余结构及间质组织组成。髓质由疏松结缔组织、丰富的血管、神经、淋巴管及少量与卵巢悬韧带相连续的平滑肌纤维组成（D错）。成年妇女卵巢的大小约为4cm×3cm×1cm，重5-6g（E错），呈灰白色。